可保护溃疡面，并有轻度致泻作用的药物是
A. 氢氧化铝
B. 三硅酸镁
C. 碳酸氢钠
D. 碳酸钙
E. 氧化镁

正确答案：B。三硅酸镁

解析：三硅酸镁可以保护溃疡面，还引起轻泻（B对）。氢氧化铝可以保护溃疡面，还引起便秘（A错）。碳酸氢钠不保护溃疡面，不影响排便（C错）。碳酸钙不保护溃疡面，引起便秘（D错）。氧化镁不保护溃疡面，引起轻泻（E错）。